按照《药品说明书规范细则（暂行）》，在“化学药品说明书格式”中不可缺少的项目是
A. 【药理毒理】
B. 【孕妇及哺乳期妇女用药】
C. 【不良反应】
D. 【老年患者用药】
E. 【儿童用药】

正确答案：C。【不良反应】

解析：本题考查药品说明书。按照《药品说明书规范细则（暂行）》，在“化学药品说明书格式”中不可缺少的项目是【不良反应】（C对）。【不良反应】是国家药品监督管理部门规定的化学药品说明书中不可缺少的项目。仅处方药说明书格式中有【药理毒理】（A错）、【孕妇及哺乳期妇女用药】（B错）、【老年患者用药】（D错）、【儿童用药】（E错）等项目。